有较强的吸电子性，可增加脂溶性及药物作用时间的官能团是
A. 羟基
B. 硫醚
C. 羧酸
D. 卤素
E. 酰胺

正确答案：D。卤素

解析：本题考查药物的典型官能团对生物活性影响。卤素（D对）是很强的吸电子基，可增加脂溶性，减慢代谢，延长药物作用时间。药物分子中引入羟基（A错），增加水溶性，还可增加位阻，从而增加药物的稳定性。硫醚（B错）可氧化成亚砜或砜，极性增强。引入羧酸（C错），酸性增强，且羧酸易成酯，成酯后脂溶性增大，易于吸收。引入酰胺（E错）后，能够与生物大分子形成氢键，增强与受体的结合力。